烟酸缺乏时的“3D”症状指的是
A. 皮炎、腹泻、痴呆
B. 水肿、腹泻、皮炎
C. 水肿、皮炎、腹泻
D. 指炎、趾炎、皮炎
E. 痴呆、先天性色盲、腹泻

正确答案：A。皮炎、腹泻、痴呆